6月龄暂不添加的辅食为
A. 强化铁的米粉
B. 蔬菜泥
C. 水果泥
D. 肉类
E. 蛋类

正确答案：E。蛋类

解析：本题考查婴儿过渡期食物的选择。蛋类中蛋黄中的铁很难吸收，吸收率仅为3%，远低于瘦肉和动物肝脏（铁吸收率20%），而且蛋黄又是最容易导致婴儿食物过敏的食材之一。因此，6月龄时开始添加辅食不应包括蛋类（E错，为本题正确答案），蛋类应在7～9个月开始添加，每日自1/4个逐渐增加至1个。